可能造成胃穿孔的抗酸药是
A. 利血平
B. 氧化镁
C. 碳酸氢钠
D. 青霉素
E. 红霉素

正确答案：C。碳酸氢钠

解析：本题考查碳酸氢钠。可能造成胃穿孔的抗酸药是碳酸氢钠（C对）。碳酸氢钠、碳酸钙因释放二氧化碳，可出现呃逆、腹胀和嗳气，引起反跳性胃酸分泌增加，导致胃穿孔。利血平（A错）属于交感神经末梢抑制剂，具有轻度降压作用，作用缓慢而持久，活动性胃溃疡者禁用此药。氧化镁（B错）为抗酸药，具有促进溃疡愈合和缓解疼痛的作用。青霉素（D错）为β-内酰胺类抗生素。红霉素（E错）为大环内酯类抗生素，后两者不用于溃疡的治疗。